与子宫不直接相连的韧带是
A. 宫骶韧带
B. 卵巢固有韧带
C. 圆韧带
D. 主韧带
E. 骨盆漏斗韧带

正确答案：E。骨盆漏斗韧带

解析：宫骶韧带（A对）起自子宫体和子宫颈交界处后面的上侧方，向两侧绕过直肠到达第2、3骶椎前面的筋膜。阔韧带位于子宫两侧呈翼状的双层腹膜皱襞，延伸至卵巢，稍增厚，形成卵巢固有韧带（B对）；阔韧带外1/3部包绕卵巢动静脉，形成骨盆漏斗韧带（E错，为本题正确答案），不与子宫相连。圆韧带（C对）起自宫角的前面、输卵管近端的稍下方，在阔韧带前叶的覆盖下向前外侧走行，到达两侧骨盆侧壁后，经腹股沟管止于大阴唇前端。主韧带（D对）在阔韧带的下部，横行于子宫颈两侧和骨盆侧壁之间（P6）。